主要表现为餐前（午、晚）低血糖的疾病是
A. 腺垂体功能减退症
B. Ⅱ型糖尿病
C. 胰岛素瘤
D. 糖原累积症
E. 肝硬化

正确答案：C。胰岛素瘤

解析：临床上按低血糖症的发生与进食的关系分为空腹（即餐前（午、晚））低血糖症和餐后低血糖症（表7-22-1），餐前低血糖症主要病因是不适当的高胰岛素血症，餐后低血糖症是胰岛素反应性释放过多。胰岛素瘤（C对）约84%为胰岛β细胞腺瘤，主要表现为胰岛素释放过多，主要表现为空腹即餐前（午、晚）低血糖（C对）（P753）。腺垂体功能减退症（A错）患者腺垂体激素分泌减少，若ACTH分泌减少可导致肾上腺皮质功能减退，糖异生作用减弱，肝糖原损耗，发生低血糖症状（P668）。Ⅱ型糖尿病（B错）的特性是胰岛素抵抗为主伴胰岛素进行性分泌不足，β细胞功能缺陷起关键作用，早期患者β细胞受损尚能部分代偿，但进食后胰岛素分泌高峰延迟，餐后3-5小时血浆胰岛素水平不适当地升高，引起反应性低血糖，属于进餐后期低血糖（P729）。糖原累积症（D错）是一种常染色体隐形遗传病，为先天性缺乏糖原代谢有关的酶，使糖原合成或分解发生障碍，有些分型虽可表现为餐前（午、晚）低血糖，但不是最佳答案（十四版实用内科学P1041）。肝硬化（E错）患者肝脏组织破坏，肝脏糖原合成和储备量减少，往往伴进食不足、消耗过多，可出现低血糖症状（十四版实用内科学P1038）。